附子的主治病证是
A. 虫积腹痛
B. 气血虚衰
C. 阳痿肢冷
D. 脚气肿痛
E. 寒饮喘咳

正确答案：C。阳痿肢冷

解析：本题考查的是附子的主治病证。附子的主治病证是阳痿肢冷（C对）。附子：【主治病证】（1）亡阳欲脱。（2）肾阳不足、命门火衰之畏寒肢冷、阳痿、宫冷、尿频。（3）脾肾阳虚之脘腹冷痛、泄泻、水肿。（4）心阳虚衰之心悸、胸痹。（5）寒湿痹痛，阳虚外感。花椒：【主治病证】（1）脘腹冷痛，中寒呕吐、泄泻。（2）虫积腹痛（A错），蛔虫、蛲虫所致者尤宜。（3）湿疹，阴痒。党参：【主治病证】（1）脾气亏虚之食欲不振、呕吐泄泻。（2）肺气亏虚之气短喘促、脉虚自汗。（3）气津两伤之气短口渴。（4）血虚（B错）萎黄，头晕心慌。吴茱萸：【主治病证】（1）中寒肝逆之头痛、吐涎沫。（2）寒湿脚气肿痛（D错），或上冲入腹之腹胀、困闷欲死。（3）寒疝腹痛，经寒痛经。（4）呕吐吞酸。（5）虚寒腹痛泄泻。干姜：【主治病证】（1）脾胃受寒或虚寒所致的腹痛、呕吐、泄泻。（2）亡阳欲脱。（3）寒饮咳喘（E错）。